全冠粘固较长时间后出现过敏性疼痛，导致其发生的原因中最不可能的是
A. 继发龋
B. 牙龈退缩
C. 邻接关系不良
D. 粘固剂溶解
E. 修复体破损

正确答案：C。邻接关系不良

解析：修复体使用之后出现过敏性疼痛。继发性龋：多由于牙体预备时龋坏组织未去净，或未做预防性扩展。牙龈退缩：修复时牙龈有炎症、水肿或粘固后牙龈萎缩等，均造成牙本质暴露，引起激发性疼痛。粘固剂脱落或溶解：修复体不密合、松动；粘固剂或粘固操作不良，粘固剂溶解、脱落、失去封闭作用。掌握“修复体戴入后的问题及处理”知识点。